凡发生医疗事故或事件，临床诊断不能明确死亡原因的，病人死亡后对其进行尸检的期限要求是：
A. 24小时内
B. 48小时内
C. 15日内
D. 30日内
E. 45日内

正确答案：B。48小时内

解析：凡发生医疗事故或事件，临床诊断不能明确死亡原因的，病人死亡后对其进行尸解的期限要求是必须在48小时内（B对）进行，但具备尸体冻存条件的可以延长至7日。